脂溶性最低，作用慢而长的药物是
A. 巴比妥
B. 硫喷妥
C. 苯巴比妥
D. 戊巴比妥
E. 司可巴比妥

正确答案：A。巴比妥

解析：本题考查巴比妥类药物。脂溶性最低，作用慢而长的药物是巴比妥（A对）。巴比妥5位无取代，脂溶性最低，口服不易吸收，不易到达中枢，作用慢而长。硫喷妥（B错）与戊巴比妥相比，2位碳上的氧原子以其电子等排体硫取代，解离度增大，且脂溶性也增加，易透过血脑屏障，静脉注射后立即生效，而由于脂溶性大，它可分配到其他脂肪和肌肉组织中，使脑中药物浓度很快下降，所以持续时间很短，为超短效催眠药。苯巴比妥（C错）的5位取代基为一个苯基和一个乙基，一般代谢氧化为酚类或醇类，由于其不易被代谢而易被重吸收，因而作用时间长。戊巴比妥（D错）5位取代基为一个戊基和一个乙基，脂溶性中等，在体内容易发生氧化代谢失活，为中效催眠药。司可巴比妥（E错）5位取代基为一个戊基和一个乙烯基，在体内容易发生氧化代谢失活，但脂溶性比戊巴比妥高，为短效催眠药。